关于股骨的叙述，下列哪项是正确的？
A. 长度约为成人身高的1/6
B. 颈与体连接处上外侧有大转子
C. 股骨头朝向外上方
D. 转子间嵴在前，转子间线在后
E. 无

正确答案：B。颈与体连接处上外侧有大转子

解析：股骨长度约为体高的 1/4（A错）。 股骨上端有朝向内上的股骨头,与骸臼相关节（C错）。股骨颈与体连接处上外侧的方形隆起，称大转子（B对）。股骨大、小转子之间，转子间嵴在前，转子间线在后（D错）。